治疗肛痈阴虚毒恋证,应首选
A. 透脓散
B. 仙方活命饮
C. 黄连解毒汤
D. 青蒿鳖甲汤合三妙丸
E. 萆薢渗湿汤

正确答案：D。青蒿鳖甲汤合三妙丸

解析：透脓散适用于肛痈火毒炽盛证（A错）。仙方活命饮（B错）、黄连解毒汤（C错）适用于热毒蕴结证。青蒿鳖甲汤合三妙丸适用于阴虚毒恋证（D对）。萆薢渗湿汤适用于湿热下注证（E错）。